阳盛格阴引起的病理变化是
A. 虚寒证
B. 虚热证
C. 真寒假热证
D. 真热假寒证
E. 阴阳两虚证

正确答案：D。真热假寒证

解析：阳盛格阴，指阳气偏盛至极，壅遏于内，排斥阴气于外，而出现内真热外假寒的病机变化，临床表现为真热假寒证（D对）。虚寒证是阳偏衰的病理变化，阳偏衰，机体阳气虚损，温煦、推动、气化等功能减退，出现虚寒内生的病机变化，临床表现为虚寒证（A错）。虚热证是阴偏衰的病理变化，阴偏衰，机体阴液不足，凉润、宁静、抑制等功能减退、阴不制阳，出现虚热内生的病机变化，临床表现为虚热证（B错）；阴盛格阳，指阳气极虚，导致阴寒之气偏盛，壅闭于里，逼迫阳气浮越于外，而出现内症寒外假热的病机变化，临床表现为真寒假热证（C错）。阴阳两虚证是阴阳互损的病理变化，阴阳互损指在阴或阳任何一方虚损的前提下，病变发展影响到相对的另一方，形成阴阳两虚（E错）。